五苓散的功用
A. 清热化湿，理气和中
B. 利湿化浊，清热解毒
C. 利水渗湿，温阳化气
D. 宣畅气机，清利湿热
E. 清热泻火，利水通淋

正确答案：C。利水渗湿，温阳化气

解析：五苓散中猪苓、茯苓、泽泻，利水渗湿；白术补气健脾以运水湿；桂枝温阳化气以助利水，并可辛温发散以祛表邪，一药而表里兼治。诸药共奏利水渗湿，温阳化气之功（C对）。